下列哪项不是引起呼吸性碱中毒的原因？
A. 低氧血症
B. 癒症发作
C. 氨中毒
D. G-杆菌败血症
E. 严重低钾血症

正确答案：E。严重低钾血症

解析：严重低钾血症（E错，为本题正确答案）时细胞外的 H+向细胞内移动，可发生代谢性碱中毒。呼吸性碱中毒是由肺通气过度引起的，低氧血症（A对）可因缺氧刺激呼吸运动增强，癒症发作（B对）时也可引起精神性通气过度，氨中毒（C对）可直接兴奋呼吸中枢致通气增强，G-杆菌败血症（D对）也能引起过度通气。